结核分枝杆菌引起机体的免疫是
A. 局部免疫
B. 传染性免疫
C. 体液免疫
D. 抗毒素免疫
E. 抗菌免疫

正确答案：B。传染性免疫

解析：结核的免疫属于传染性免疫（又称有菌免疫），即只有当结核分枝杆菌或其组分存在体内时才有免疫力。一旦体内的结核分枝杆菌或其组分全部消失，免疫也随之不存在。而抗结核免疫主要是细胞免疫。掌握“结核、非结核分枝杆菌”知识点。